患者，女，40岁，全身水肿3年，下肢明显，小便短少，身体困重，胸闷，纳呆，舌质淡，苔白腻，脉沉缓，其治法是
A. 宜肺解毒，利湿消肿
B. 运脾化湿，通阳利水
C. 健脾温阳，利水消肿
D. 温肾助阳，化气行水
E. 活血祛瘀，化气行水

正确答案：B。运脾化湿，通阳利水

解析：水肿分阴水和阳水，阳水多为实证，阴水多属里证、虚证或虚实夹杂证。阳水分五个证型，风水相搏证、湿毒浸淫证、水湿浸渍证、湿热壅盛证。阴水分三个证型，脾阳虚衰证、肾阳衰微证、瘀水互结证。患者水肿、胸闷、身重、苔白腻，脉沉缓，水湿之邪浸渍，为阳水水湿浸渍证，其治法为运脾化湿，通阳利水（B对）。宣肺解毒，利湿消肿为阳水湿毒浸淫证执法（A错）；健脾温阳，利水消肿为脾阳虚衰证治法（C错）；温肾助阳，化气行水为肾阳衰微证的治法（D错）；活血祛瘀，化气行水为瘀水互结证的治法（E错）。